测定外源化学物LD₅₀（LC₅₀），通常要求计算实验动物接触化合物之后多长时间内的总死亡数
A. 2天
B. 4天
C. 7天
D. 14天
E. 30天

正确答案：D。14天